关于肝硬化自发性腹膜炎，正确的描述是
A. 一般起病急，伴高热寒战，剧烈腹痛，出现板状腹、反跳痛
B. 致病菌多为金黄色葡萄球菌
C. 易出现顽固性腹水
D. 治疗时应加强利尿治疗
E. 应进行腹水培养，待培养结果出来后有针对性应用抗生素治疗

正确答案：C。易出现顽固性腹水

解析：肝硬化自发性腹膜炎患者由于反复发作，易出现顽固性腹水（C对）。起病缓慢者多有低热、腹胀或腹水持续不减；病情进展快者，腹痛明显，腹水增长迅速，严重者诱发肝性脑病、出现中毒性休克等，体检发现轻重不等的全腹压痛和腹膜刺激征（A错）。致病菌多为革兰阴性杆菌，而非金黄色葡萄球菌（B错）。加强利尿可诱发肝性脑病、肝肾综合征（D错）。治疗一般选用肝毒性小、主要针对革兰阴性杆菌并兼顾革兰阳性球菌的抗生素，疗效不满意时根据治疗反应和药敏结果进行调整（E错）。